与肾相表里的是
A. 胆
B. 胃
C. 小肠
D. 大肠
E. 膀胱

正确答案：E。膀胱

解析：肾和膀胱通过经脉构成了相互络属的关系（E对）。肝和胆（A错）通过经脉相互络属构成了表里关系。脾与胃（B错）相表里。心与小肠（C错）相表里。肺与大肠（D错）相表里。